在医德品质诸要素中，居于主导和核心地位的是
A. 医德价值
B. 医德意志
C. 医德认识
D. 医德信念
E. 医德情感

正确答案：D。医德信念

解析：通过修养过程医务人员能够使得行医行为始终吻合医学职业精神的要求。所以在医德品质诸要素中，居于主导和核心地位的是医德信念（D对）。道德行为是指个体表现出符合道德的行为。医学道德行为，是医务人员面临患者疾病治疗时，从多种可行的处置模式中经过意志的判断与选择，自觉克服困难、排除障碍，做出有利于患者决策的心理过程及其结果。可见，医学道德行为修养即包括内在的意志活动，又包括意志活动推动的行为表现（B错）。医学道德认知是指医务人员对客观存在的医学道德理论、原则、规范的认识与理解。认知是行为的先导（C错）。医学道德情感是指医务人员对医学道德的情感体验，分正负两性和无动于衷三类（E错）。